阳黄初起见表证者，其治法是
A. 清热利湿，佐以泻下
B. 利湿化浊，佐以清热
C. 清热解毒，凉营开窍
D. 健脾和胃，温化寒湿
E. 解表清热利湿

正确答案：E。解表清热利湿

解析：黄疸阳黄初起见表证者的病机是湿热兼表证，治宜解表清热利湿（E对）。清热利湿，佐以泻下，为黄疸阳黄热重于湿的治法（A错）。利湿化浊，佐以清热，黄疸阳黄湿重于热的治法（B错）。清热解毒，凉营开窍，为黄疸急黄的治法（C错）。健脾和胃，温化寒湿，为黄疸阴黄的治法（D错）。